RPD的非适应证为
A. 双侧游离缺失
B. 新近拔牙者，等待伤口愈合期间
C. 牙弓一侧牙槽骨缺损较大
D. 需升高颌间距离者
E. 口腔溃疡，经久不愈者

正确答案：E。口腔溃疡，经久不愈者

解析：本题考查可摘局部义齿的适应证。RPD的非适应证为口腔溃疡，经久不愈者（E错，为本题的正确答案）。可摘局部义齿RPD的适用范围极其广泛，从个别牙缺失到上颌或下颌仅预留一个牙的大范围缺损，甚至伴有软硬组织缺损时均可采用，包括双侧游离缺失（A对）、新近拔牙者，等待伤口愈合期间（B对）、牙弓一侧牙槽骨缺损较大（C对）、需升高颌间距离者（D对）等。可摘局部义齿的适用范围虽广，但也有不宜采用的情况，包括严重的牙体、牙周或黏膜病变未得到有效治疗控制者如口腔溃疡经久不愈者。